流行病学统计，女性发病多于男性的有
A. 白斑
B. 盘状红斑狼疮
C. 龋病
D. 地图舌
E. 牙龈癌

正确答案：B。盘状红斑狼疮

解析：本题考查盘状红斑狼疮的流行病学。盘状红斑狼疮的发病率女性高于男性（B对）。白斑男性的发病率高于女性（A错）。影响龋病发病的宿主因素主要包括牙和唾液，与性别无关（C错）。地图舌未明确有典型的性别特点（D错）。牙龈癌男性大于女性（E错）。